谷胱甘肽主要用于解救
A. 丙烯腈中毒
B. 氟化物中毒
C. 一氧化碳中毒
D. 重金属中毒
E. 有机磷中毒

正确答案：A、B、C、D。丙烯腈中毒；氟化物中毒；一氧化碳中毒；重金属中毒

解析：本题考查谷胱甘肽。谷胱甘肽用于丙烯腈（A对）、氟化物（B对）、一氧化碳（C对）、重金属（D对）等中毒。有机磷中毒（E错）使用碘解磷定、氯磷定、双复磷、双解磷解救。